磨牙固定桥的连接体面积大，位于邻面的
A. 切1/3偏舌侧
B. 切1/3偏唇侧
C. 中1/3偏舌侧
D. 中1/3偏（牙合）方
E. 近（牙合）缘偏颊侧

正确答案：D。中1/3偏（牙合）方

解析：磨牙固定桥的连接体面积大，位于邻面的中1/3偏（牙合）方。掌握“固定桥的设计”知识点。